月经量多或经期延长但周期基本正常，应首先考虑
A. 子宫内膜癌
B. 子宫颈癌
C. 子宫肌瘤
D. 无排卵性功能失调性子宫出血
E. 宫颈息肉

正确答案：C。子宫肌瘤

解析：月经量多或经期延长但周期基本正常，应首先考虑子宫肌瘤（C对）：肌瘤使宫腔增大，子宫内膜面积增加并影响子宫收缩，此外肌瘤可能使肿瘤附近的静脉挤压，导致子宫内膜静脉丛充血与扩张，从而引起经量增多、经期延长，由于不影响雌孕激素分泌，故月经周期正常。子宫内膜癌（P315）（A错）主要表现为绝经后阴道流血和绝经过渡期月经紊乱，未绝经者可表现为月经增多及经期延长，月经紊乱。子宫颈癌（P306）（B错）常表现为接触性出血，也可表现为不规则阴道流血，或经期延长、经量增多。无排卵性功能失调性子宫出血（P345）（D错）最常见的症状是子宫不规则出血，表现为月经周期紊乱，经期长短不一，经量不定或增多，甚至大量出血。宫颈息肉（P256）（E错）多数无症状，少数表现为阴道分泌物增多，淡黄色或脓性，性交后出血，月经间期出血，但经量、经期正常，月经周期正常。